哈钦森牙是侵犯了哪颗牙齿
A. 切牙
B. 尖牙
C. 第一前磨牙
D. 第一磨牙
E. 第二磨牙

正确答案：A。切牙

解析：先天性梅毒牙是由于梅毒螺旋体感染牙胚，侵犯成釉器使釉质发育障碍，在恒切牙、第一恒磨牙釉质产生特征性的发育不全改变。病变切牙称Hutchinson切牙，其近远中面向切缘而不是牙颈部逐渐变细，形成螺丝刀样外观，切缘中间常有一新月形凹陷或深裂隙。这些改变在上颌中切牙最为明显。掌握“氟牙症、先天性梅毒牙与牙本质形成缺陷”知识点。